硫脲类药物治疗甲亢的主要机制是
A. 抑制甲状腺激素的外周作用
B. 促进甲状腺素合成
C. 抑制甲状腺素合成
D. 抑制甲状腺素释放
E. 破坏甲状腺滤泡上皮细胞

正确答案：C。抑制甲状腺素合成

解析：硫脲类药物主要是抑制甲状腺激素合成（C对）。硫脲类药物中丙基硫氧嘧啶主要是甲少甲状腺激素的合成，还有抑制甲状腺激素的外周作用，它不是主要作用（A错）。硫脲类药物治疗甲亢的主要机制是抑制甲状腺素合成不是促进甲状腺素合成（B错）。碘化物可抑制甲状腺激素释放（D错），但作用时间短暂，数周后即失效，且长期服用碘剂还可使甲亢症状加重，仅用于抢救甲亢危象和甲亢的手术治疗前准备等。放射性碘131治疗甲状腺具有高度选择性摄取"碘的功能"碘在核衰变时能放射出β射线使部分甲状腺滤泡上皮细胞被破坏（E错），产生炎症、坏死和萎缩，导致功能丧失，从而减少甲状腺激素的合成及分泌，达到治疗甲亢的目的。